匙状指多见的疾病是
A. 先天性心脏病
B. 支气管扩张
C. 肝硬化
D. 缺铁性贫血
E. 肺脓肿

正确答案：D。缺铁性贫血

解析：匙状指多见于缺铁性贫血，偶见于风湿热、甲癣等（D对）。先天性心脏病多与先天性因素有关，大多数都是遗传所致。青紫是青紫型先天性心脏病（如大血管错位，法乐氏四联症等）的突出表现。可于出生后持续存在，也可于出生后三至四个月逐渐明显，在口唇、指（趾）甲床、鼻尖最明显。而潜伏青紫型心脏病（如室间隔缺损、房间隔缺损、动脉导管未闭）平时并无青紫，只是在活动、哭闹、屏气或患肺炎时才出现青紫，晚期发生肺动脉高压和右心衰竭时可出现持续青紫（A错）。支气管扩张常有持续或反复咳嗽、咳大量脓痰，反复咯血（B错）。肝硬化肝癌早期可出现消化系统症状和肝掌蜘蛛痣等，失代偿期可出现胸腹壁静脉曲张，肝脾肿大，皮肤黏膜出血导致紫癜，内分泌失调，黄疸，发热，肝性脑病，移动性浊音阳性，雌激素灭活障碍，食欲减小，体重减退等（C错）。肺气肿一般表现早期无症状或稍一活动出现呼吸急促（E错）。